透皮贴剂
A. 严禁直接口服
B. 禁用于红肿部位
C. 使用后不宜马上饮水
D. 一般应整片吞服
E. 保持舌下含服至少5分钟，仰卧姿势约20分钟

正确答案：B。禁用于红肿部位

解析：本题考查各种剂型的正确使用。透皮贴剂禁用于红肿部位（B对）。泡腾片一般宜用100～150ml凉开水或温水浸泡，可迅速崩解和释放药物，严禁直接服用或口含（A错）。含漱剂多为水溶液，含漱后不宜马上饮水（C错）和进食，以保持口腔内药物浓度。服用缓、控释制剂的药片或胶囊时，除另有规定外，一般应整片或整丸吞服（D错），严禁嚼碎和击碎分次服用。舌下片含服时间一般控制在5min左右（E错），含后30min内不宜吃东西或饮水。